哪种药物不适宜长期使用作为控制菌斑预防牙周病的方法
A. 氯己定
B. 抗生素
C. 血根碱
D. 酚类化合物
E. 季铵化合物

正确答案：B。抗生素

解析：本题考查化学制剂控制菌斑。抗生素（B错，为本题的正确答案）不适宜长期使用作为控制菌斑预防牙周病的方法。抗生素能不同程度的控制菌斑、消除炎症，可用于牙周病的治疗以及辅助牙周病的预防，虽然某些抗生素对牙周病的治疗有较好的疗效，但是使用抗生素作为控制菌斑预防牙周病的方法是不适宜的，长期使用可抑制口腔中正常菌群而导致菌群失调，并且可能产生耐药菌株，此外还可能产生药物相互作用等问题。氯己定（A对）对菌斑的控制作用表现在可减少唾液中吸附到牙面上的细菌数量；使唾液糖蛋白对牙面的吸附作用减弱；可与牙面釉质结合从而阻碍唾液细菌对牙面的吸附；可与Ca²⁺竞争，而取代Ca²⁺与唾液中凝集细菌的酸性凝集银子作用并使之沉淀，从而改变菌斑细菌的内聚力，抑制细菌的聚积和对牙面的吸附；血根碱（C对）具有抗菌斑和抗龈炎的作用，常含于漱口剂和牙膏中使用；酚类化合物（D对）能清除菌斑中的内毒素，因此可明显降低菌斑的毒性；季铵化合物（E对）能杀灭革兰阳性和革兰阴性细菌，特别是对革兰阳性菌有较强的杀灭作用。氯已定、血根碱、酚类化合物和季铵化合物长期使用不会对人体有较大影响，因此较适宜长期使用作为控制菌斑预防牙周病的方法。